某女，57岁。因上呼吸道感染，给予10%葡萄糖注射液250ml，加入注射用双黄连3.6g静脉滴注约输入150ml时，患者出现皮肤瘙痒，继之全身出现红色皮疹、呼吸困难、大汗、血压75/50mmHg，立即停用注射用双黄连，给予生命体征监护，并经静脉推注地塞米松，皮下注射肾上腺素，3小时后症状逐渐消失。根据《药品不良反应报告和监测管理办法》要求，报告该病例不良反应最迟应不超过
A. 5个工作日
B. 15个工作日
C. 10个工作日
D. 20个工作日
E. 30个工作日

正确答案：B。15个工作日

解析：本题考查的是药品不良反应的报告程序。因上呼吸道感染，给予10%葡萄糖注射液250ml，加入注射用双黄连3.6g静脉滴注约输入150ml时，患者出现皮肤瘙痒，继之全身出现红色皮疹、呼吸困难、大汗、血压75/50mmHg，立即停用注射用双黄连，给予生命体征监护，并经静脉推注地塞米松，皮下注射肾上腺素，3小时后症状逐渐消失。根据《药品不良反应报告和监测管理办法》要求，报告该病例不良反应最迟应不超过15个工作日（B对）。我国《药品不良反应报告和监测管理办法》中要求对新的或严重的药品不良反应病例需用有效方式快速报告，必要时可以越级报告，最迟不超过15个工作日。